引起水体富营养化的原因主要是水中哪种物质含量过度升高
A. 氮、磷等元素
B. 氮、钾等元素
C. 氯酚
D. 溶解氧
E. 铁、锌等元素

正确答案：A。氮、磷等元素

解析：本题考查引起水体富营养化的原因。引起水体富营养化的原因主要是水中氮、磷等元素（A对BCDE错）含量过度升高，从而造成水体中藻类大量繁殖，水中有机物增加、溶解氧下降，水质恶化。